石菖蒲的主治病证是
A. 健忘
B. 顽痹久痛
C. 湿浊中阻
D. 耳聋耳鸣
E. 痰湿蒙蔽心窍之神昏

正确答案：A、C、D、E。健忘；湿浊中阻；耳聋耳鸣；痰湿蒙蔽心窍之神昏

解析：本题考查的是石菖蒲的主治病证。石菖蒲的主治病证是健忘（A对）、湿浊中阻（C对）、耳聋耳鸣（D对）与痰湿蒙蔽心窍之神昏（E对）。石菖蒲：【主治病证】（1）痰湿蒙蔽心窍之神昏，癫痫，耳聋，耳鸣。（2）心气不足之心悸失眠、健忘恍惚。（3）湿浊中阻之脘腹痞胀，噤口痢。穿山龙：【主治病证】（1）风湿痹痛，跌打伤肿。（2）咳嗽痰多。（3）闭经，疮肿。穿山龙善舒筋，力较强，顽痹、久痹（B错）多用，兼伤肿或咳嗽痰多者尤宜。